红大戟除泻水逐饮外，又能
A. 祛痰利咽
B. 去积杀虫
C. 消肿散结
D. 祛痰止咳
E. 活血祛瘀

正确答案：C。消肿散结

解析：本题考查的是红大戟的功效。红大戟除泻水逐饮外，又能消肿散结（C对）。红大戟：【功效】泻水逐饮，消肿散结。巴豆：【功效】泻下冷积，逐水退肿，祛痰利咽（A错），蚀疮去腐。牵牛子：【功效】泻下，逐水，去积，杀虫（B错）。芫花：【功效】泻水逐饮，祛痰止咳（D错）。外用杀虫疗疮。大黄：【功效】泻下攻积，清热泻火，解毒止血，活血祛瘀（E错）。